根据子母补泻取穴法，心包经虚证应选用
A. 少冲
B. 中冲
C. 太渊
D. 太白
E. 太冲

正确答案：B。中冲

解析：《难经·六十九难》提出“虚者补其母，实者泻其子”的思想，将五输穴配属五行，然后按“生我者为母，我生者为子”的原则，虚证用母穴，实证用子穴。这一取穴法亦称子母补泻取穴法。在具体运用时，分本经子母补泻和他经子母补泻两种方法。按照本经子母补泻法，心包经的虚证应“补其母”，心包为“火”，“木”生“火”，“木”为“火”之母，因此，应选心包经中属“木”的五输穴，即井穴中冲（B对）。